含有高能磷酸键的糖代谢中间产物是
A. 6-磷酸果糖
B. 磷酸烯醇式丙酮酸
C. 3-磷酸甘油醛
D. 磷酸二羟丙酮
E. 6-磷酸葡萄糖

正确答案：B。磷酸烯醇式丙酮酸